下列各项，不引起高钾血症的疾病是
A. 急性肾功能衰竭
B. 严重溶血
C. 缺铁性贫血
D. 挤压综合征
E. 代谢性酸中毒

正确答案：C。缺铁性贫血

解析：高钾血症常见于：1.肾脏排钾减少，如急性或慢性肾功能不全及肾上腺皮质功能减退等（挤压综合征（D对）是指人体四肢或躯干等肌肉丰富的部位遭受重物（如，石块、土方等）长时间的挤压，在挤压解除后出现身体一系列的病理生理改变。临床上主要表现为以肢体肿胀、肌红蛋白尿、高血钾为特点的急性肾功能衰竭（A对）。如不及时处理，后果常较为严重，甚至导致患者死亡）。2.摄入或注射大量钾盐，超过肾脏排钾能力。 3.严重溶血（B对）或组织损伤，红细胞或组织内钾大量释放入细胞外液。4.组织缺氧或代谢性酸中毒（E对）时细胞内钾大量转移至细胞外液（C错，为本题正确答案）。